下列可引起呕吐物多且有粪臭味的疾病是
A. 胃潴留
B. 肠梗阻
C. 慢性胆囊炎
D. 幽门梗阻
E. 有机磷中毒

正确答案：B。肠梗阻

解析：可引起呕吐物多且有粪臭味的疾病是肠梗阻（B对）。呕吐物带发酵、腐败气味见于胃潴留（A错）、幽门梗阻（D错）。慢性胆囊炎（C错）、有机磷中毒（E错）呕吐无特异性表现。